小动物接触易挥发液态化合物的急性毒性试验，最适宜采用的染毒方法是
A. 喂饲
B. 灌胃
C. 吞咽胶囊
D. 静式吸入
E. 皮肤敷贴

正确答案：D。静式吸入